贫血性梗死灶呈锥体形改变的脏器是
A. 肺
B. 脑
C. 肾
D. 肠
E. 心

正确答案：C。肾

解析：贫血性梗死易发生于组织结构较致密、侧支循环不充分的器官，如肾、脾、心和脑组织等。由于肾（C对）的血管呈锥形分支，故其梗死灶也呈锥体形改变。肺（A错）的梗死灶虽然也呈锥形，但肺脏易发生出血性梗死。脑（B错）的梗死灶无特殊形状（P59），往往经坏死、变软、液化后形成囊状或被星形胶质细胞和胶质纤维替代，形成胶质瘢痕。肠（D错）的梗死灶呈节段形。心（E错）的梗死灶呈地图状。